问卷法是社会医学的重要研究方法之一。问卷是由组问题和相应答案所构成的表格，问卷设计的好坏将影响所收集到的资料的有效性及可信度，从而影响问卷调查的效果。以下属于问卷设计中“双重装填”错误的问句是
A. 你最近两周是否生病
B. 你是否抽烟喝酒
C. 你是否患有慢性病
D. 你是否看过医生
E. 你住院后，是否转诊到其他医院

正确答案：B。你是否抽烟喝酒